下列属于黏合剂的是
A. 羧甲基淀粉钠
B. 硬脂酸镁
C. 乳糖
D. 羟丙基甲基纤维素溶液
E. 水

正确答案：D。羟丙基甲基纤维素溶液

解析：本题考查片剂的常用辅料。羟丙基甲基纤维素（D对）属于黏合剂。片剂的常用辅料主要包括稀释剂（填充剂）、崩解剂、润滑剂、润湿剂和黏合剂等。常用的黏合剂有淀粉浆、甲基纤维素、羟丙纤维素、羟丙甲纤维素、羧甲基纤维素钠、乙基纤维素、聚维酮、明胶、聚乙二醇等。常用的崩解剂有：干淀粉、羧甲淀粉钠（CMS-Na）（A错）、低取代羟丙基纤维素（L-HPC）、交联羧甲基纤维素钠（CCMC-Na）、交联聚维酮（PVPP）和泡腾崩解剂等。常用的润滑剂（广义）有硬脂酸镁（B错）、微粉硅胶、滑石粉、氢化植物油、聚乙二醇类、十二烷基硫酸钠等。常用的稀释剂有淀粉、乳糖（C错）、糊精、蔗糖、预胶化淀粉、微晶纤维素、无机盐类等。常用的润湿剂有蒸馏水（E错）和乙醇，其中蒸馏水是首选的润湿剂。